痿证可见
A. 手足抽搐
B. 手足肿胀
C. 手足麻木
D. 手足软弱
E. 手足不遂

正确答案：D。手足软弱

解析：本题考查的是望姿态异常的主要内容及临床意义。痿证可见手足软弱（D对）。望姿态异常的主要内容及临床意义：患者的动静姿态和体位，也常常是病理变化的外在反映。不同的疾病，表现出不同的姿态和体位。从总的方面来看：“阳主动，阴主静”，喜动者属阳，喜静者属阴。如患者卧位、身轻自能转侧、面常向外，多为阳、热、实证；身重难于转侧、面常向里、精神萎靡者，多为阴、寒、虚证。若患者卧时仰面伸足、常揭去衣被、不欲近火者，多属热证；卧时蜷缩成团、喜加衣被或向火取暖者，多属寒证。若坐而仰首，多是痰涎壅盛的肺实证；坐而俯首、气短懒言者，多属肺虚或肾不纳气之证。坐而不得卧、卧则气逆，多是心阳不足。水气凌心、咳逆倚息不得卧，每发于秋冬的，多是内有伏饮。对于某些患者形体异常动作的观察，很能帮助诊断。如眼睑、口唇或手指、足趾不时颤动，见于急性热病，则为动风发痉的先兆；见于虚损久病，则为气血不足，经脉失养。四肢抽搐（A错），多见于风病，如痫证、破伤风、小儿急惊风、小儿慢惊风等。手足拘挛、屈伸不利，属于肝病的筋急，或为寒凝筋脉，或为血脉损伤，筋膜失养。足或手软弱无力，行动不灵、多属于痿证。一侧手足举动不遂（E错），或麻木（C错）不仁，多为中风偏瘫；一侧手足疼痛而肌肉萎缩，多为风邪耗血，正虚邪留。项背强直、角弓反张、四肢抽搐，则为痉病。症状为手足肿胀（B错）的疾病，2022年考试指南未明确说明。